治疗大肠埃希菌所致的尿路感染，不宜选用的抗菌药是
A. 左氧氟沙星
B. 阿莫西林
C. 头孢呋辛
D. 阿奇霉素
E. 复方磺胺甲噁唑

正确答案：D。阿奇霉素

解析：本题考查治疗尿路感染的药物。治疗大肠埃希菌所致的尿路感染，不宜选用的抗菌药是阿奇霉素（D错，为本题正确答案）。阿奇霉素属于大环内酯类抗生素，一般用于非多种耐药淋病奈瑟菌所致的尿道炎和宫颈炎。喹诺酮类（A对）、青霉素类（B对）、头孢类药物（C对）、磺胺类（E对）用于抗尿路感染。